处方中表示“必要时（临时备用）”的缩写是
A. qs.
B. prn
C. hs.
D. St.
E. sos.

正确答案：E。sos.

解析：本题考查处方中常见的外文缩写及其含义。表示“必要时（临时备用）”的缩写是sos.（E对）。qs.（A错）表示“适量”。prn（B错）表示“必要时（长期备用）”。hs.（C错）表示“临睡时”。St.（D错）表示“立即”。